采用高效液相色谱法测得庆大霉素C1组分的含量为35.0%。已知其真实含量为50.0%。则相对误差为
A. 0.7
B. 0.3
C. 0.15
D. -0.15
E. -0.3

正确答案：E。-0.3

解析：本题考查相对误差的计算。相对误差=绝对误差/真值，如题，则题中的相对误差=（35-50）/50=0.3（B对）。